某女，51岁。少气懒言，乏力自汗，面色苍白，舌淡而嫩，脉细弱，中医辨证是
A. 气滞血瘀
B. 气不摄血
C. 气随血脱
D. 气虚血瘀
E. 气血两虚

正确答案：E。气血两虚

解析：本题考查的是气血同病常见证候的临床表现。少气懒言，乏力自汗，面色苍白，舌淡而嫩，脉细弱，中医辨证是气血两虚（E对）。气血同病常见证候的临床表现及辨证要点：气为阳，血为阴。气与血有阴阳相随、互为依存的关系，故气血变化的互相影响，在临床上非常多见。气血同病证候，常见气滞血瘀、气血两虚、气不摄血、气随血脱证等。1.气滞血瘀（A错）证的临床表现及辨证要点：气滞血瘀证的临床表现，常见胸胁胀满走窜疼痛，性情急躁，并兼见痞块刺痛拒按，舌紫暗或有瘀斑等。妇女还可见月经闭止，或痛经、经色紫暗有块，乳房胀痛等症状。一般以病程较长和肝经循行部位的疼痛痞块为辨证要点。2.气血两虚证的临床表现及辨证要点：气血两虚证的临床表现，常见少气懒言，乏力自汗，面色苍白或萎黄，心悸失眠，舌淡而嫩，脉细弱等。多以气虚与血虚的症状同见为辨证要点。3.气不摄血（B错）证的临床表现及辨证要点：气不摄血证的临床表现，常见出血的同时，见有气短，倦怠乏力，面色苍白，脉软弱细微、舌淡等气虚的症状。多以出血和气虚症状同见为辨证要点，脾有统摄血液在脉中运行和运化水谷精微的功能，所以气不摄血证，也常见到脾虚的症状。4.气随血脱（C错）证的临床表现及辨证要点：气随血脱证的临床表现，常见于大量出血的同时，见面色白，四肢厥冷，大汗淋漓，甚至晕厥，脉微细或弱等症。多以大量出血时，随即出现气脱的症状为辨证要点。气虚血瘀（D错）为胸痹的辨证。胸痹气虚血瘀证：【症状】胸痛隐隐，遇劳则发，神疲乏力，气短懒言，心悸自汗。舌胖有齿痕，色淡暗，苔薄白，脉弱而涩，或结、代。【治法】益气活血，通脉止痛。【方剂应用】基础方剂为补阳还五汤（当归、川芎、黄芪、桃仁、红花、地龙、赤芍）加减。【中成药应用】常用中成药有芪参益气滴丸、参桂胶囊、心力丸、活心丸。